审方的内容不包括
A. 有无配伍禁忌
B. 有无漏写剂量
C. 有无超量用药
D. 有无漏写药味
E. 有无重开药名

正确答案：D。有无漏写药味

解析：本题考查的是审方的内容。审方的内容不包括有无漏写药味（D错，为本题正确答案）。药师调剂处方时必须做到“四查十对”：查处方，对科别、姓名、年龄；查药品，对药名（E对）、剂型、规格、数量；查配伍禁忌（A对），对药品性状、用法用量（BC对）；查用药合理性，对临床诊断。